下列哪项不是受精卵着床的必备条件
A. 胚泡细胞分化合体滋养细胞
B. 胚泡和子宫内膜同步发育
C. 透明带消失
D. 孕妇体内有少量的孕酮
E. 出现允许受精卵着床的窗口期

正确答案：D。孕妇体内有少量的孕酮

解析：受精卵着床必须具备如下条件：①透明带消失；②胚泡细胞滋养细胞分化出合体滋养细胞；③胚泡和子宫内膜同步发育且功能协调；④孕妇体内有足够数量的孕酮；⑤子宫出现允许受精卵着床的窗口期（一个极短的敏感时间段）。掌握“妊娠生理”知识点。